龋损下方牙髓血管充血,血管通透性增加,液体渗出,组织水肿,有纤维蛋白渗出,此时称为
A. 急性浆液性牙髓炎
B. 急性化脓性牙髓炎
C. 慢性闭锁性牙髓炎
D. 慢性增生性牙髓炎
E. 慢性溃疡性牙髓炎

正确答案：A。急性浆液性牙髓炎

解析：本题考查牙髓炎。龋损下方牙髓血管充血，血管通透性增加，液体渗出，组织水肿，有纤维蛋白渗出，此时称为急性浆液性牙髓炎（A对）。炎症迅速向周围扩散，中性粒细胞广泛浸润至整个牙髓组织，形成多处小脓肿，此时，若炎性渗出未得到及时引流，髓腔压力极度增加，最终使整个牙髓液化坏死，此时称为急性化脓性牙髓炎（B错）。牙髓缓慢充血，髓角有脓肿形成，脓肿周围常有肉芽组织包绕，而其余牙髓组织正常，属于慢性闭锁性牙髓炎（C错）。炎性增生的牙髓组织从露髓孔穿出可见于慢性增生性牙髓炎（D错）。慢性溃疡性牙髓炎（E错）患牙牙髓组织暴露于口腔，典型临床特征是遇冷热刺激痛，刺激去除后疼痛仍然持续一段时间；镜下可见患牙有较大的穿髓孔，穿髓孔表面为炎性渗出物、食物残渣及坏死物质覆盖，其下方为炎性肉芽组织和新生的胶原纤维，深部有活力牙髓组织表现为血管充血扩张，其中散在有淋巴细胞、浆细胞、巨噬细胞等慢性炎细胞浸润。